宜在夏季采收的根及根茎类药材有
A. 明党参
B. 浙贝母
C. 延胡索
D. 石菖蒲
E. 太子参

正确答案：B、C、E。浙贝母；延胡索；太子参

解析：本题考查植物药、动物药、矿物药的采收原则。下列中药，宜夏季采收的药材是浙贝母（B对）、延胡索（C对）、太子参（E对）。植物药类：药用部位不同，采收时间也不同。（1）根及根茎类：一般在秋、冬两季植物地上部分将枯萎时及春初发芽前或刚露苗时采收，此时根或根茎中贮藏的营养物质最为丰富，通常所含有效成分也比较高，如牛膝、党参、黄连、大黄、防风等。但也有例外，有些中药由于植株枯萎时间较早，即在夏季及时采收，如浙贝母、延胡索、半夏、太子参等；而明党参（A错）则在春季采收较好。石菖蒲（D错）【采收加工】秋、冬二季挖取，除去须根及泥沙，晒干。